某药的置换价为1.6，当制备栓重2g、平均含药0.16g的10枚栓剂时，需加入基质可可豆脂
A. 18g
B. 19g
C. 20g
D. 36g
E. 38g

正确答案：B。19g